横突孔中通行的结构有
A. 椎动脉
B. 眼动脉
C. 颈外动脉
D. 颈内动脉
E. 以上都不是

正确答案：A。椎动脉

解析：颈椎横突有孔，称横突孔, 有椎动脉（穿 1 -6 横突孔）和椎静脉通过（A对）。颈内动脉经颈动脉管入颅后行于此颈内动脉沟内（D错）。